患者，女，65岁，间断腹胀、纳差6年，因病情加重伴精神恍惚3天为主诉入院，实验室检查：ALT200U/L，AST320U/L，诊断为肝硬化失代偿期、肝性脑病。患者乙肝病史20年，间断服用中药（具体不详）治疗。糖尿病史10年，便秘多年，3～4天排便一次。现计划对该患者进行抗乙肝治疗，宜首选的抗病毒药物是
A. 干扰素α
B. 聚乙二醇干扰素α
C. 恩替卡韦
D. 利巴韦林
E. 更昔洛韦

正确答案：C。恩替卡韦

解析：本题考查恩替卡韦。宜首选的抗病毒药物是恩替卡韦（C对）。核苷（酸）类抗病毒药主要包括拉米夫定、恩替卡韦、阿德福韦、替比夫定、替诺福韦等。其中恩替卡韦和替诺福韦被推荐为临床治疗乙肝的一线药物。拉米夫定、替比夫定和阿德福韦为临床治疗乙肝的二线药物。临床上干扰素α（A错）不首先推荐用于乙肝的治疗。聚乙二醇干扰素α（B错）用于慢性乙型肝炎和慢性丙型肝炎。利巴韦林（D错）用于防治流感、副流感、甲、乙、丙型肝炎、麻疹、腮腺炎、水痘、单纯疱疹、带状疱疹、病毒性眼角膜炎、疱疹性口腔炎、小儿腺病毒肺炎，可能还有抗肿瘤作用。更昔洛韦（E错）用于预防及治疗免疫功能缺陷病人的巨细胞病毒感染，如艾滋病患者，接受化疗的肿瘤患者，使用免疫抑制剂的器官移植病人。